早期识别脑梗死非常敏感的检查方法是
A. CT
B. MRI
C. TCD
D. 心脏彩超
E. 颈动脉彩超

正确答案：B。MRI